患者，男，53岁，因纳差、食欲减退来药店购药。药师应推荐的药品是
A. 多潘立酮片
B. 酵母片
C. 乳酶生片
D. 甲氧氯普胺片
E. 铝碳酸镁咀嚼片

正确答案：B。酵母片

解析：本题考查消化不良用药。酵母片（B对）可用于食欲减退者。食欲减退者可服用增加食欲药，如口服维生素B₁、维生素B₆，一次10mg，一日3次；或口服干酵母片，一次0.5～2g，一日3～4次。对餐后不适综合征可选用胃动力药，伴有恶心或呕吐者可选用甲氧氯普胺片（D错）和多潘立酮片（A错）。乳酶生片（C错）、胃蛋白酶合剂可用于偶然性消化不良或进食蛋白质食物过多者。铝碳酸镁咀嚼片（E错）可用于胃食管反流病患者胸痛偶发。